《医疗机构制剂配制质量管理规范（试行）》规定，本《规范》的实施及制剂质量是由
A. 医疗机构制剂室主任负责
B. 医疗机构制剂室专人负责
C. 医疗机构药剂科主任负责
D. 医疗机构负责人负责
E. 医疗机构药剂部门药检室负责人负责

正确答案：D。医疗机构负责人负责